牙周膜中数量最多的是
A. 成骨细胞
B. 牙周膜干细胞
C. 上皮剩余细胞
D. 成牙骨质细胞
E. 成纤维细胞

正确答案：E。成纤维细胞

解析：本题考查牙周膜中的细胞构成。成纤维细胞（E对）是牙周膜中数量最多的细胞。牙周膜干细胞（B错）是牙周膜中的一种未分化的间充质干细胞，能够维持牙周组织的稳态，参与牙周组织的再生。成牙骨质细胞（D错）分布在邻近牙骨质的牙周膜中，细胞扁平，胞核圆或卵圆形，平铺在根面上。上皮剩余（C错）是牙根发育期上皮根鞘残留下的上皮细胞，为牙周膜中邻近牙骨质的纤维间隙中小的上皮条索或上皮团，与牙根表面平行排列，也称Malassez上皮剩余。成骨细胞（A错）在骨形成时，于邻近牙槽骨表面大量存在，呈立方状，胞核大，核仁明显，胞质嗜碱性，静止期的成骨细胞为梭形。